老年人心理健康的常见问题不包括
A. 不适应离退休生活
B. 对外界环境不适应
C. 主观健康水平评价差
D. 老年人的性生活
E. 对死亡的恐惧

正确答案：B。对外界环境不适应